临床上化妆品眼损害大多是由于
A. 眼部皮肤粘膜特别敏感
B. 用于眼部的化妆品刺激性较强
C. 非眼部化妆品误入眼内
D. 不正确使用眼部化妆品
E. 眼部化妆品的使用频繁

正确答案：C。非眼部化妆品误入眼内

解析：本题考查化妆品眼损害的原因。眼部皮肤和黏膜是特别敏感部位，一些在皮肤不引起损害的化妆品，在眼部则可引起不同程度的损害。临床上化妆品眼损害大多是由于非眼部化妆品误入眼内（C对ABDE错）。